提高问卷回收率的方法，不包括
A. 版面设计简洁、美观
B. 问卷问题数量合适且容易回答
C. 争取权威机构的支持
D. 注重调查员的培训
E. 避免让调查对象事先对研究目的和意义有所了解

正确答案：E。避免让调查对象事先对研究目的和意义有所了解

解析：本题考查提高问卷回收率的方法。提高问卷回收率的方法，不包括避免让调查对象事先对研究目的和意义有所了解（E错，为本题正确答案）。提高问卷回收率的方法有多种，常用的有：1.版面设计简洁、美观（A对）且容易阅读。2.问卷问题数量合适且容易回答（B对），最好采用打勾、画圈等选择形式。3.争取权威机构的支持（C对），以其名义发放问卷，易引起重视。4.让调查对象事先对研究的目的和意义有所了解，从而更愿意接受调查。5.方便调查对象。例如：在邮寄调查时夹寄一个填写好并贴足邮资的回函信封。6.注重调查员的培训（D对）。调查员良好素质与访谈技巧能提高回复率。7.赠送纪念品以表明调查者要求配合的恳切希望，并表达谢意。